阴亏血虚者应慎用的药是
A. 止血药
B. 消食药
C. 退虚热药
D. 祛风湿药
E. 清热凉血药

正确答案：D。祛风湿药

解析：本题考查的是祛风湿药使用注意。阴亏血虚者应慎用的药是祛风湿药（D对）。凡以祛除风湿、解除痹痛为主要功效的药物，称为祛风湿药。本类药中的部分药物辛温香燥，易耗伤阴血，故阴亏血虚者应慎用。止血药（A错）：凡以制止机体内外出血为主要功效的药物，称为止血药。在使用凉血止血和收敛止血药时，必须注意有无瘀血，若有瘀血未尽，应酌加活血化瘀药，不能单纯止血，以免留瘀。消食药（B错）：凡以消食化积、增进食欲为主要功效的药物，称为消食药。部分消食药有耗气之弊，故气虚及无食积、痰滞者宜慎用。退虚热药（C错）与清热凉血药（E错）属于清热药。凡药性寒凉，以清解里热为主要功效的药物，称为清热药。本类药药性寒凉，易伤脾胃，凡脾胃虚弱、食少便溏者慎服；热病易伤津液，清热燥湿药易化燥伤阴津，故阴虚津伤者亦当慎用；阴盛格阳、真寒假热之证，尤须明辨，不可妄投；要中病即止，避免克伐太过，损伤正气。